下列何者属于乙脑治疗“把三关”之一
A. 抗病毒治疗
B. 抗昏迷
C. 抗循环衰竭
D. 抗肾衰竭
E. 抗呼吸衰竭

正确答案：E。抗呼吸衰竭

解析：高热、抽搐及呼吸衰竭是危及患者生命的三大主要症状，且可互为因果，形成恶性循环，因此必须及时给予相应处理。降温、镇静止痉、防治呼吸衰竭（E对）为针对三大主要症状的治疗，称为“把三关”。根据引起呼吸衰竭的不同原因和病变程度给予相应的治疗。氧疗可选用鼻导管或面罩给氧，纠正患者缺氧状态；由脑水肿所致者用脱水剂治疗；中枢性呼吸衰竭有呼吸表浅、节律不整或紫绀时，可用呼吸兴奋剂。抗病毒治疗（A错）、抗昏迷（B错）、抗循环衰竭（C错）、抗肾衰竭（D错）均不属于"把三关"。